HLA-B27阳性相关的疾病是
A. 类风湿性关节炎
B. 系统性红斑狼疮
C. 强直性脊柱炎
D. 肾小球性肾炎咯血综合征
E. 胰岛素依赖型糖尿病

正确答案：C。强直性脊柱炎